女，20岁。左乳肿块2年，增长缓慢。查体：左乳外上象限扪及2.5cm分叶肿块，质硬、光滑、边界清楚、活动、无压痛，左侧腋窝未扪及肿大淋巴结。最可能的诊断是
A. 乳腺癌
B. 乳房纤维腺瘤
C. 乳房肉瘤
D. 乳腺囊性增生症
E. 乳管内乳头状瘤

正确答案：B。乳房纤维腺瘤

解析：青年女性患者，左乳外上象限肿块2年，增长缓慢，肿块质硬，光滑，边界清楚，活动，无压痛，无淋巴结肿大，应考虑乳腺纤维腺瘤（ B对）。乳腺癌（A错）常见于绝经期妇女，表现为乳房肿块，边界不清，易侵犯肌肉，皮肤表面可见扩张的静脉。乳房肉瘤（C错）好发于50岁以上的妇女，表现为乳房肿块，体积可较大，表皮因肿瘤迅速增大而呈现紧张发亮、微红色，且有静脉怒张，但有明显境界但一般不发生粘连与“桔皮样变”。乳腺囊性增生症（D错）常见于中年妇女，主要表现为乳房胀痛与肿块，肿块可呈颗粒状、结节状、片状，大小不一，坚韧不硬，边界不清。乳管内癌头状瘤（E错）多见于经产妇，表现为反复乳头溢血，可于乳晕区扪及直径数mm的小结节，质软可推动，轻压肿块可有乳头血性溢液。